患者，男，45岁。自觉心慌，时息时作，健忘失眠。治疗应首选
A. 三阴交
B. 神门
C. 足三里
D. 太溪
E. 合谷

正确答案：B。神门

解析：神门穴的主治要点为心痛、心烦、惊悸、怔忡、健忘、失眠、痴呆、癫狂痫等心与神志病证；高血压；胸胁痛等病证，且神门是治疗健忘失眠的要穴（B对ACDE错）。